长正中的距离多为
A. 0.1～0.3mm
B. 0.3～0.5mm
C. 0.5～1.0mm
D. 0.8～1.0mm
E. 0.8～1.2mm

正确答案：C。0.5～1.0mm

解析：确定正中关系（牙合）（后退接触位）后能自如地直向前滑动到牙尖交错位（如有偏斜不超过0.5mm），其滑动距离多在0.5～1.0mm，这一距离称为长正中。人群中两位者约占90%。协调关系属生理性关系。掌握“下颌姿势位、三类颌位与前伸、侧方（牙合）颌位”知识点。